在孕妇腹壁上听诊，与母体心率相一致的音响是
A. 胎心音
B. 子宫杂音
C. 脐带杂音
D. 胎动音
E. 肠蠕动音

正确答案：B。子宫杂音

解析：子宫杂音（B对）为血液流过扩大的子宫血管时出现的吹风样低音响，与母体心率相一致。正常母体心率每分钟在60～100次之间，正常胎心音（A错）每分钟110～160次（P43）。脐带杂音（C错）为脐带血流受阻出现的吹风样低音响，与胎心音一致。正常胎动（D错）为3～5次/小时，正常肠蠕动音（E错）为4～5次/分，与母体心率都不一致。